“利复星”是左旋氧氟沙星的
A. 通用名
B. 法定名
C. 商品名
D. 注册名
E. 习用名

正确答案：C。商品名

解析：本题考查药品的商品名。“利复星”是左旋氧氟沙星的商品名（C对）。中国药典委员会按照“中国药品通用名称命名法则”制定的药品名称为中国药品通用名称（A错）。国家药典或药品标准采用的通用名称为法定名称（B错）。药品无注册名（D错）。习用名（E错）是指某药品在临床上的习惯称呼。